关于“光化学烟雾事件”，叙述正确的是
A. 污染物主要来自汽车尾气
B. 多发生在早晨
C. 主要污染物是SO₂
D. 多发生于寒冷季节
E. 多发生于河谷地带

正确答案：A。污染物主要来自汽车尾气

解析：本题考查光化学型烟雾事件的相关内容。光化学型烟雾事件的污染来源是石油制品燃烧（A对）；主要污染物是VOC、NOₓ、O₃、SO₂、CO、PANs（C错）；发生季节多在夏秋季（D错）；发生时间多在中午或午后（B错）；逆温类型是下沉逆温；地理条件为南北纬度60°以下地区易发生（E错）。